急性结石胆囊炎常见的致病菌是
A. 铜绿假单胞菌
B. 大肠埃希菌
C. 厌氧菌
D. 幽门螺杆菌
E. 粪肠球菌

正确答案：B。大肠埃希菌

解析：急性结石性胆囊炎的致病菌多从胆道逆行进入胆囊，其致病菌多为肠道菌属，以大肠埃希菌（B对）最常见。铜绿假单胞菌（A错）、厌氧菌（C错）及粪肠球菌（E错）也可见于胆囊炎；幽门螺旋杆菌（D错）也可经十二指肠逆行进入胆道，但以上细菌均不常见。